去某病因的死亡人数占全死因死亡人数的比例是
A. L’X
B. P’X
C. mX
D. eX
E. r’X

正确答案：E。r’X

解析：本题考查去死因死亡比例的计算。去死因死亡比例是去某病因的死亡人数占全死因死亡人数的比例，记为r’x（E对ABCD错）。